关于促胃液素的叙述，正确的是
A. 产生促胃液素的细胞存在于胃体和胃底粘膜内
B. 蛋白质消化产物及HCl是引起促胃液素释放的主要因素
C. 促胃液素对壁细胞有很强的刺激分泌作用
D. 促胃液素的最小活性片段是其N端的4个氨基酸
E. 切除胃窦的病人，促胃液素分泌不受影响

正确答案：C。促胃液素对壁细胞有很强的刺激分泌作用

解析：促胃液素（胃泌素）可促进壁细胞分泌胃酸（C对）。促胃液素（胃泌素）是由胃窦部（A错）G细胞分泌的，而胃酸和内因子是由存在于胃体和胃底的壁细胞分泌的。蛋白质的消化产物，如肽类和氨基酸，是引起胃泌素释放的主要因素，但胃酸（HCl）可直接抑制胃窦部G细胞释放促胃液素（B错）。促胃液素具有生物活性的最小片段是其C端的4个氨基酸（D错），该片段与促胃液素的生理作用密切相关。切除胃窦的病人，分泌胃泌素的G细胞减少，导致促胃液素分泌减少（E错）。